腕横纹中央，掌长肌腱与桡侧腕屈肌腱之间的穴位是
A. 阳溪
B. 太渊
C. 大陵
D. 神门
E. 腕骨

正确答案：C。大陵

解析：阳溪位于腕背横纹桡侧，当拇短伸肌腱与拇长伸肌腱之间的凹陷中（A错）。太渊位于腕掌侧横纹桡侧，桡动脉的桡侧凹陷中（B错）。大陵位于腕横纹中央，掌长肌腱与桡侧腕屈肌腱之间（C对）。神门位于腕横纹尺侧端，尺侧腕屈肌腱的桡侧凹陷处（D错）。腕骨位于手背尺侧，小指展肌起点外缘（E错）。记忆：在腕横纹上的穴位从尺侧到桡侧依次是，神门、大陵、太渊。